5岁小儿按公式计算身高体重及头围约是
A. 118cm  22Kg  54cm
B. 114cm  21Kg  53cm
C. 111cm  20Kg  52cm
D. 108cm  19Kg  51cm
E. 105cm  18Kg  50cm

正确答案：E。105cm  18Kg  50cm

解析：5岁小儿按公式计算体重：5×2＋8=18kg（E对）。2-12岁身高的计算公式：身高（cm）=年龄（岁）×7＋75。2岁时头围约48cm，2-15岁头围仅增加6-7cm。